某肺心病并发呼吸衰竭、心功能不全、休克患者血气分析结果如下pH7.25,PaCO₂10.7kPa(80mmHg),BE-4.6mmol/L,SB21mmol/L,其酸碱紊乱类型为
A. 呼吸性酸中毒
B. 代谢性酸中毒
C. 呼吸性酸中毒合并代谢性酸中毒
D. 呼吸性酸中毒合并代谢性碱中毒
E. 代谢性酸中毒合并代谢性碱中毒

正确答案：C。呼吸性酸中毒合并代谢性酸中毒

解析：BE负值增大提示为代谢性酸中毒，发生代谢性酸中毒时HCO3-减少，患者同时存在PaCO₂（正常范围为33~46 mmHg）增高，两者变化范围相反，提示存在酸碱一致型混合型酸碱平衡紊乱，故诊断为呼吸性酸中毒合并代谢性酸中毒（C对）。